关于妇女常见病筛查建议的间隔时间及检查次数，不正确的是
A. 每位妇女每1～3年进行1次妇女常见病筛查
B. 20～34岁的妇女每2～3年行1次宫颈细胞学筛查
C. 35～64岁的妇女应每2年行1次宫颈细胞学筛查
D. 40岁以下应每1～2年进行1次乳腺超声检查
E. 40岁以上的妇女应每2年进行1次乳腺X线检查

正确答案：C。35～64岁的妇女应每2年行1次宫颈细胞学筛查

解析：本题考查妇女常见病筛查。建议每位妇女每1～3年进行1次妇女常见病筛查（A对），鉴于各种方法均可能出现一定的假阴性和假阳性结果，存在漏诊的可能性，因此，根据妇女年龄、筛查疾病、筛查方法，确定筛查间隔年限。宫颈癌筛查：建议20～34岁的妇女每2～3年行1次宫颈细胞学筛查（B对），35～64岁的妇女应每年行1次宫细胞学筛查（C错，为本题正确答案），40岁以下应每1～2年进行1次乳腺超声检查（D对），40岁以上的妇女应每2年进行1次乳腺X线检查（E对）。